男，75岁，腹胀、便秘、食欲不振半年，无腹痛、腹泻、便血，无呕吐，既往体健。查体：T36.5°C，P80次/分，R18次/分，BP140/80mmHg，双肺呼吸音清，心律齐，腹软，无压痛，Murphy征阴性。腹部B超提示胆囊萎缩。可能受影响的情况是
A. 蛋白质分解
B. 单糖吸收
C. 脂肪分解产物吸收
D. 蛋白质分解产物吸收
E. 淀粉类食物消化分解

正确答案：C。脂肪分解产物吸收

解析：老年男性患者，腹胀、便秘、食欲不振，腹部B超提示胆囊萎缩。肝脏分泌的胆汁主要储存于胆囊内，进食后，食物及消化液可刺激胆囊收缩，将储存于胆囊内的胆汁排入十二指肠，促进脂肪的消化。若胆囊萎缩，则胆囊收缩功能下降，胆汁不能足量排入十二指肠来促进脂肪的消化，因此会影响脂肪分解产物吸收（C对）。